个性心理特征是什么时期出具雏形的
A. 婴儿期
B. 幼儿期
C. 学龄前期
D. 学龄期
E. 青春期

正确答案：C。学龄前期

解析：本题考查学龄前期的特点。学龄前期（C对ABDE错）的特点包括：1.体格生长较以前缓慢；2.运动发育方面开始有较好的平衡，可以两足交替上下楼梯；能模仿绘画或临摹简单的图形；3.语言、思维等能力发育较快，掌握生活常用语言，好奇多问，模仿性强；4.个性心理特征初具雏形。